环境污染对人群健康的影响主要是
A. 急慢性中毒、“三致”作用
B. 慢性中毒、亚急性中毒、慢性中毒
C. 慢性中毒、致癌作用
D. 致癌、致畸、致突变
E. 慢性中毒、“三致”作用

正确答案：A。急慢性中毒、“三致”作用

解析：本题考查环境污染对人群健康的影响。环境污染对人群健康的影响主要是急慢性中毒、“三致”作用（A对BCDE错）。急慢性中毒是指暴露于有毒物质中，短时间内可引起急性中毒，长期暴露可引起慢性中毒的现象。“三致”作用是指某些有毒物质可能会引起致癌、致畸、致突变等现象。